治疗心力衰竭时硝普钠的最大用量是
A. 0.3μg/（kg·min）
B. 0.5μg/（kg·min）
C. 5μg/（kg·min）
D. 10μg/（kg·min）
E. 20μg/（kg·min）

正确答案：D。10μg/（kg·min）

解析：硝普钠为动、静脉血管扩张剂，能同时降低前、后负荷。降低心室舒张末压，有利于缓解由于心力衰竭导致的肺水肿。硝普钠成人常用剂量：起始剂量每分钟0.5μg/kg，根据治疗反应以每分钟0.5μg/kg递增，常用剂量为每分钟3μg/kg，极量为每分钟10μg/kg。